毛果芸香碱的主要适应证是
A. 青光眼
B. 角膜炎
C. 结膜炎
D. 视神经水肿
E. 晶状体浑浊

正确答案：A。青光眼

解析：毛果芸香碱能直接作用于副交感神经（包括支配汗腺交感神经）节后纤维支配的效应器官的M胆碱受体，尤其对眼和腺体作用明显。对眼的作用有：缩瞳、降低眼内压和调节痉挛；对腺体：促进腺体分泌。临床应用于：青光眼（A对）、虹膜睫状体炎。